能治疗强心苷中毒引起的窦性心动过缓和房室传导阻滞的药物是
A. 洋地黄毒苷
B. 地高辛
C. 阿托品
D. 哌替啶
E. 考来烯胺

正确答案：C。阿托品

解析：本题考查阿托品。阿托品（C对）是M胆碱受体阻断药，能治疗强心苷中毒引起的窦性心动过缓和房室传导阻滞；洋地黄毒苷（A错）、地高辛（B错）为强心苷类正性肌力药；哌替啶（D错）用于各种剧痛如创伤性疼痛、手术后疼痛等，易成瘾；考来烯胺（E错）主要用于Ⅱ型高脂血症、动脉粥样硬化以及肝硬化。